霍乱患者肠道伴有出血者粪便性状是
A. 黄水样便
B. “米泔水”样便
C. 洗肉水样便
D. 黏液便
E. 柏油样便

正确答案：C。洗肉水样便